气逆病变，常见
A. 闷胀疼痛
B. 面红目赤
C. 少腹胀满重坠
D. 突然昏厥，不省人事
E. 汗出不止

正确答案：B。面红目赤

解析：气逆常见于肺胃肝等脏腑，肝气上逆者，表现为头痛头胀、面红目赤、易怒等症（B对）。气滞于某一经络或局部，可出现相应部位的胀满、疼痛（A错）。气陷的形成，多由气虚发展而来，与脾气不升关系最为密切，常伴有面色无华，气短乏力，语声低微，脉弱无力，以及腰腹胀满重坠、便意频频等症（C错）。气闭指气闭阻于内，不能外出，以致清窍闭塞，出现昏厥的病机变化，其多发病急骤，以突然昏厥，不省人事为特点，可自行缓解，亦有因闭不复而亡者（D错）。气脱指气不内守，大量向外脱失，以致机体功能突然衰竭的病机变化，临床表现为面色苍白，汗出不止，目闭口开，全身瘫软，手撒，二便失禁，脉微欲绝或虚大无根等症状（E错）。